不能耸肩是由于哪块肌肉瘫痪所致？
A. 斜方肌
B. 三角肌
C. 冈上肌
D. 冈下肌
E. 背阔肌

正确答案：A。斜方肌

解析：斜方肌（A对）瘫痪后，则产生“塌肩”现象，即不能耸肩。